液体制剂中，薄荷挥发油属于
A. 增溶剂
B. 防腐剂
C. 矫味剂
D. 着色剂
E. 潜溶剂

正确答案：C。矫味剂

解析：本题考查液体制剂常用的附加剂。薄荷挥发油属于矫味剂（C对）中的芳香剂。矫味剂分为甜味剂、芳香剂、胶浆剂、泡腾剂等类型。增溶剂（A错）为表面活性剂；防腐剂（B错）指能抑制微生物生长繁殖的添加剂；着色剂（D错）系指能够改善制剂的外观颜色的色素；潜溶剂（E错）指能增加难溶性药物溶解度的混合溶剂。